男性，26岁，5天来鼻及牙龈出血，皮肤瘀斑，血红蛋白55g，白细胞10.0×10⁹/L，血小板16×10⁹/L。骨髓增生活跃，幼稚细胞占80%，胞浆有大小不等颗粒及成堆棒状小体，过氧化酶染色强阳性。本患者治疗首选
A. DA方案
B. 全反式维A酸
C. 羟基尿
D. VP方案
E. 骨髓移植

正确答案：B。全反式维A酸

解析：患者诊断为急性早幼粒细胞白血病（APL），治疗首选全反式维A酸（B对）。DA方案（P576）（A错）是急性髓系白血病（非急性早幼粒细胞白血病）的首选治疗；羟基脲（P579）（C错）常用于慢性粒细胞白血病的治疗及降低白细胞处理；VP方案（P575）（D错）是急性淋巴细胞白血病的基础用药；骨髓移植（E错）用于白血病缓解后的治疗。